女，30岁，因再生障碍性贫血3个月入院输血治疗。输注悬浮红细胞30分钟后出现寒战。既往有输血史。查体：T39.5℃，BP130/75mmHg。患者最可能出现的输血不良反应是
A. 输血相关循环超负荷
B. 过敏反应
C. 输血相关移植物抗宿主病
D. 非溶血性发热性反应
E. 急性溶血性输血反应

正确答案：D。非溶血性发热性反应

解析：患者曾因再障有过输血史，此次输入悬浮红细胞30分钟后出现寒战、高热（39.1～41℃即为高热），其最可能出现的输血不良反应是非溶血性发热性反应（D对）。发热反应是最常见的早期输血并发症之一，多发生于输血开始后15分钟～2小时内，主要表现为畏寒、寒战和高热。输血相关循环超负荷（P23）（A错）是由输血过量或速度过快引起，主要表现为呼吸急促、发绀或咳吐血性泡沫痰等急性心衰及肺水肿的表现，一般不出现寒战、高热。过敏反应（P22）（B错）主要表现为皮肤局限性或全身性瘙痒或荨麻疹。输血相关移植物抗宿主病（P24）（C错）主要表现为发热、皮疹、肝炎、腹泻、骨髓抑制和感染。急性溶血性输血反应（P22）（E错）主要表现为输注少量血型不合的血后，立即出现沿输血静脉的红肿及疼痛，寒战、高热、呼吸困难、腰背酸痛等表现。